人体维生素A缺乏
A. 血红蛋白浓度降低
B. 血浆视黄醇结合蛋白浓度降低
C. 血浆蛋白质含量减少
D. 红细胞转酮醇酶活力系数＞25%
E. 红细胞谷胱甘肽还原酶活性系数＞1.2%

正确答案：B。血浆视黄醇结合蛋白浓度降低